患者男，33岁，一周前感冒，继之眼睑浮肿，并延及全身，伴肢节酸楚，发热恶寒，小便少。治疗用方是
A. 疏凿饮子
B. 越婢加术汤
C. 实脾饮
D. 五苓散
E. 猪苓汤

正确答案：B。越婢加术汤

解析：患者一周前感冒，风邪袭表，肺失宣降，不能通调水道，下疏膀胱，故见水肿，伴肢节酸楚，发热恶寒，小便少；风为阳邪，其性轻扬，风水相搏，推波助澜，故见眼睑浮肿，并延及全身；治疗需散风清热，宣肺行水，方药选用越婢加术汤加减（B对）。疏凿饮子（A错）可以清热利湿，利水消肿，用于治疗湿热内蕴证。实脾饮（C错）可以温运脾阳，利水消肿，用于治疗脾虚湿困证。五苓散（D错）可以利水渗湿，温阳化气，用于治疗伤寒太阳膀胱蓄水证。猪苓汤（E错）可以利水渗湿，清热养阴，治疗水热互结证。